某女，36岁。妊娠3个月。1周来，脘腹胀满。昨日家庭聚会，又食酸辣鱼，导致腹痛吐泻。宜选用的药是
A. 陈皮
B. 紫苏
C. 生姜
D. 苍耳子
E. 淡豆豉

正确答案：B。紫苏

解析：本题考查的是紫苏的功效。妊娠3个月。1周来，脘腹胀满。昨日家庭聚会，又食酸辣鱼，导致腹痛吐泻。宜选用的药是紫苏（B对）。紫苏：【功效】发表散寒，行气宽中，安胎，解鱼蟹毒。陈皮（A错）：【功效】理气调中，燥湿化痰。生姜（C错）：【功效】发汗解表，温中止呕，温肺止咳。苍耳子（D错）：【功效】散风寒，通鼻窍，除湿止痛，止痒。淡豆豉（E错）：【功效】解表，除烦。